甘露醇的作用是
A. 抑制碳酸酐酶
B. 与醛固酮受体结合
C. 提高血浆渗透压产生组织脱水作用
D. Na⁺-Cl⁻抑制剂
E. Na⁺-K⁺-2Cl⁻抑制剂

正确答案：C。提高血浆渗透压产生组织脱水作用

解析：本题考查甘露醇的药理作用。甘露醇是脱水药，静脉注射后能迅速提高血浆渗透压，使组织间液向血浆转移而产生组织脱水作用（C对）。